体温持续在39~40℃，24小时内波动不超过1℃持续数日或数周称为
A. 弛张热
B. 波状热
C. 稽留热
D. 间歇热
E. 不规则热

正确答案：C。稽留热